关于药品标准制定原则的说法，错误的是
A. 根据“准确、权威、国际领先”的原则选择并规定检测方法
B. 体现“安全有效、技术先进、经济合理”的原则
C. 检测项目应体现药品内在质量的控制
D. 标准规定的各种限量应结合实践

正确答案：A。根据“准确、权威、国际领先”的原则选择并规定检测方法

解析：本题考查的是药品标准的制定原则。药品标准应根据“准确、灵敏、简便、迅速”的原则选择并规定检测、检验方法（A错，为本题正确答案）。药品标准的制定原则：药品标准与药品生产技术和质量管理水平密切相关，药品标准的高低反映了一个国家或者企业的综合实力。一方面，药品标准不能订得过高，导致企业能力所不及，增加额外成本与负担；另一方面，标准也不可降得太低，造成药品质量良莠不齐，给用药者带来伤害。药品标准的制定原则包括以下内容。1.坚持质量第一，体现“安全有效、技术先进、科学严谨、经济合理”的原则（B对），尽可能与国际标准接轨，起到促进质量提高，择优发展的作用。2.充分考虑生产、流通、使用各环节对药品质量的影响因素，有针对性地制定检测项目，切实加强对药品内在质量的控制（C对）。3.根据“准确、灵敏、简便、迅速”的原则选择并规定检测、检验方法，既要考虑现阶段的实际水平和条件，又要体现新技术的应用和发展。4.标准规定的各种限量应结合实践（D对），要保证药品在生产、储运、销售和使用过程中的质量。